阿托品抗休克作用的机制是
A. 收缩血管，增加外周阻力
B. 扩张血管，改善微循环
C. 兴奋心脏，增加心输出量
D. 松弛支气管平滑肌，改善症状
E. 以上均非

正确答案：B。扩张血管，改善微循环

解析：休克在补充血容量的前提下，大剂量阿托品可通过解除血管痉挛、舒张外周血管、改善微循环第十版药理学（B对AE错）而使回心血量及有效循环血量增加，血压回升，用于治疗中毒性痢疾、爆发型流行性脑脊髓膜炎、中毒性肺炎等所致的感染性休克。阿托品有兴奋心脏的作用，可增加心脏心输出量，为其治疗迷走神经过度兴奋所致窦房阻滞、房室阻滞等缓慢性心律失常以及窦房结功能低下而出现的室性异位节律的机制（C错）。阿托品可松弛多种内脏平滑肌，如胃肠道平滑肌、膀胱逼尿肌、支气管平滑肌，可改善胃肠绞痛以及支气管哮喘的症状，但不是其用于抗休克的作用机制（D错）。